称为“贮痰之器”的脏是
A. 肝
B. 脾
C. 肾
D. 肺
E. 心

正确答案：D。肺

解析：本题考查的是五脏的其他称谓。称为“贮痰之器”的脏是肺（D对）。称为“生痰之源”的脏是脾（B错）。